根据《执业药师职业资格制度规定》，关于执业药师职业资格管理的说法，正确的有
A. 参加全部科目和免试部分科目的考试人员，执业药师职业资格考试成绩均以4年为一个周期管理
B. 以欺骗手段取得《执业药师注册证》的，由发证机关撤销其注册证，3年内不予执业药师注册
C. 严禁《执业药师注册证》挂靠，持证人注册单位与实际工作单位不符的，由发证机关撤销其注册证，并作为个人不良信息记入全国执业药师注册管理信息系统
D. 药品经营企业配备的执业药师，其《执业药师注册证》应由省级药品监督管理部门批准有效期为3年

正确答案：B、C。以欺骗手段取得《执业药师注册证》的，由发证机关撤销其注册证，3年内不予执业药师注册；严禁《执业药师注册证》挂靠，持证人注册单位与实际工作单位不符的，由发证机关撤销其注册证，并作为个人不良信息记入全国执业药师注册管理信息系统

解析：本题考查的是执业药师执业活动的监督管理。根据《执业药师职业资格制度规定》，关于执业药师职业资格管理的说法，正确的有以欺骗手段取得《执业药师注册证》的，由发证机关撤销其注册证，3年内不予执业药师注册（B对）；严禁《执业药师注册证》挂靠，持证人注册单位与实际工作单位不符的，由发证机关撤销其注册证，并作为个人不良信息记入全国执业药师注册管理信息系统（C对）。国家药品监督管理局与人力资源社会保障部按照职责分工对执业药师职业资格制度实施和执业药师执业行为进行监督和检查。负责药品监督管理的部门按照有关规定对执业药师配备情况及其执业活动实施监督检查，包括监督检查以不正当手段取得《执业药师职业资格证书》，以欺骗、贿赂等不正当手段取得《执业药师注册证》，未按规定配备执业药师，挂靠《执业药师注册证》（执业药师“挂证”）单位买卖、租借《执业药师注册证》等违法违规行为。同时将建立执业药师个人诚信记录，对其执业活动实行信用管理。执业药师的违法违规行为、接受表彰奖励及处分等，作为个人诚信信息由负责药品监督管理的部门及时记入全国执业药师注册管理信息系统；执业单位和执业药师应当对负责药品监督管理的部门的监督检查予以协助、配合，不得拒绝、阻挠。按照12号文及药品经营质量管理相关规定，对以不正当手段取得《执业药师职业资格证书》的，按照《专业技术人员资格考试违纪违规行为处理规定》（人力资源社会保障部令第31号）相关规定处理。以欺骗、贿赂等不正当手段取得《执业药师注册证》的，由发证部门撤销《执业药师注册证》，三年内不予执业药师注册，构成犯罪的，依法追究刑事责任。对存在“挂证”行为的执业药师，撤销其《执业药师注册证》，在全国执业药师注册管理信息系统进行记录，并予以公示，在不良信息记录撤销前，不能再次注册执业。药品零售企业存在“挂证”执业药师的，按严重违反《药品经营质量管理规范》情形进行处罚。执业药师考试成绩管理以四年为一个周期，参加全部科目考试的人员须在连续四年内通过全部科目的考试，才能获得执业药师职业资格。免试部分科目的人员须在连续两个考试年度内通过应试科目（A错）。考试成绩全国有效。我国执业药师实行注册制度，国家药品监督管理局负责执业药师注册的政策制定和组织实施，指导全国执业药师注册管理工作。各省、自治区、直辖市药品监督管理部门负责本行政区域内的执业药师注册管理工作。取得执业药师职业资格的药学专业技术人员，经执业单位考核同意，通过全国执业药师注册管理信息系统向所在地注册管理机构申请注册。经批准注册者，由执业药师注册管理机构核发国家药监局统一样式的《执业药师注册证》，方可从事相应的执业活动。未经注册者，不得以执业药师身份执业。执业药师注册有效期为五年（D错）。